患者，男，60岁。劳动中突发左侧头痛，伴呕吐，面赤，舌强语謇，舌红苔黄，脉弦数查体：血压195/105mmHg（26/14kPa），右侧上下肢瘫痪，右下肢病理反射阳性。应首先考虑的是
A. 痫证
B. 中风
C. 痿证
D. 厥证
E. 痹证

正确答案：B。中风

解析：脑梗死是指各种原因所致脑部血液供应障碍，导致脑组织缺血、缺氧性坏死，出现相应神经功能缺损。脑梗死的临床常见类型有脑血栓形成、脑栓塞和腔隙性梗死等。脑梗死约占全部脑卒中的80%，以半身不遂、口眼歪斜、语言不利为临床特征。本病与中医学“中风”病相类似，归属于“中风”“类中风”范畴（B对）。痫证以发作性神识恍惚，或突然昏仆、口吐涎沫、两目上视、四肢抽搐，或口中如有猪羊叫声等为临床特征的神志异常疾病。又称癫痫、癫疾，俗称羊癫风、羊痫风（A错）。痿证是肢体筋脉弛缓，软弱无力，不能随意运动或伴有肌肉萎缩的一种病证（C错）。厥证是以突然昏倒，不省人事，四肢逆冷为主要临床表现的一种病证。病情轻者，一般在短时内苏醒，但病情重者，则昏厥时间较长，甚至一厥不复而导致死亡（D错）。“痹”有闭阻不通之义，因风、寒、湿、热等外邪侵袭人体，闭阻经络，气血不能畅行，引起肌肉、筋骨、关节等酸痛、麻木、重着、伸屈不利，甚或关节肿大灼热等为主要临床表现。临床根据病邪偏胜和症状特点，分为行痹、痛痹、着痹和热痹（E错）。